舍格伦综合征的病理表现不包括
A. 淋巴细胞浸润
B. 小叶轮廓仍保留
C. 形成上皮岛
D. 病变常从小叶周边开始
E. 导管增生扩张

正确答案：D。病变常从小叶周边开始

解析：本题考查舍格伦综合征的病理表现。舍格伦综合症是一种以慢性唾液腺炎、干燥性角膜炎和口干症为主要临床表现，病因不明的自身免疫性疾病。病变从小叶中心开始（D错，为本题的正确答案），早期淋巴细胞浸润（A对），将腺泡分开。病变严重时，小叶内腺泡全部消失，但小叶外形轮廓仍保留（B对）。小叶内导管上皮增生，形成上皮岛（C对）。小叶内导管增生扩张（E对），有的形成囊腔。